男60岁，诉咀嚼时牙齿过敏，查牙面磨耗重，探敏，冷（-），叩（-），不松，牙石I°，拟诊
A. 浅龋
B. 中龋
C. 牙本质过敏
D. 逆行性牙髓炎
E. 可复性牙髓炎

正确答案：C。牙本质过敏

解析：本题考查牙本质敏感症。男60岁，诉咀嚼时牙齿过敏，查牙面磨耗重，探敏，冷（-），叩（-），不松，牙石I°，拟诊牙本质过敏（C对）。牙本质过敏一般是指由于磨损等原因导致牙本质暴露出现酸痛感，磨损越快越重，酸痛感就越明显，该患者患牙牙面磨耗重，使得牙本质暴露，从而引起牙本质过敏。浅龋位于釉质内，患者一般无主观症状，遭受外界的物理和化学刺激亦无明显反应（A错）。中龋时患者对酸甜饮食敏感，过冷过热饮食也能产生酸痛感觉，冷刺激尤为显著，刺激去除后症状立即消失（B错）。逆行性牙髓炎患牙均有长时间的牙周炎病史，可诉有牙齿松动，患牙表现为冷热刺激痛，对叩诊的反应为轻度疼痛（+）或中度疼痛（++）（D错）。可复性牙髓炎对冷测表现为一过性敏感，且反应迅速，当去除刺激后，疼痛随即消失（E错）。